具有应力中断作用的卡环是
A. 三臂卡环
B. 圈形卡环
C. 回力卡环
D. 对半卡环
E. 延伸卡环

正确答案：C。回力卡环

解析：本题考查卡环的种类。回力卡环（C对）的设计使远中支托不与基托或连接杆相连，力通过人工牙和基托首先传导到基托下组织，可减轻基牙受力，起到应力中断的作用。三臂卡环（A错）、圈形卡环（B错）、对半卡环（D错）、延伸卡环（E错）的设计均是（牙合）支托与基托或连接杆相连，力通过（牙合）支托直接传导到基牙上，没有应力中断的作用。